关于等渗性缺水，正确的是
A. 水和钠按其在血液中的正常比例丢失
B. 外科临床中较少见
C. 也称慢性缺水
D. 血清钠浓度明显降低
E. 血清钠浓度明显增高

正确答案：A。水和钠按其在血液中的正常比例丢失

解析：等渗性缺水又称急性缺水或混合性缺水，是外科临床中最常见的类型。即血钠浓度正常的细胞外液容量减少。等渗性缺水的特征是水和钠按其在血液中的正常比例丢失（A对）。等渗性缺水是外科临床中最常见的类型（B错）。等渗性缺水又称急性缺水或混合性缺水（C错），等渗性缺水是血钠浓度正常的细胞外液容量减少，无钠盐及渗透压的明显改变（DE错）。